男，58岁。突感头、颈项部剧烈疼痛，大汗伴恶心、呕吐、眩晕。查体：急性病容，四肢活动自如，脑膜刺激征阳性。最可能的诊断是
A. 脑栓塞
B. 椎基底动脉供血不足
C. 高血压脑病
D. 蛛网膜下腔出血
E. 脑血栓形成

正确答案：D。蛛网膜下腔出血

解析：中老年患者突发头部剧烈疼痛、恶心、呕吐及眩晕等明显颅内压增高的表现，脑膜刺激征阳性，无偏瘫等脑实质损害表现，最可能诊断为蛛网膜下腔出血（D对）。脑栓塞（A错）及脑血栓形成（E错）患者常有明显偏瘫、偏身感觉障碍等脑实质损害症状，极少出现脑膜刺激征的表现。椎基底动脉供血不足（B错）最常表现为眩晕、平衡障碍、眼球运动异常和复视。高血压脑病（C错）患者常有高血压病史，大多数有头痛、抽搐和意识障碍三大特征。